虎斑心
A. 细胞水肿
B. 玻璃样变
C. 粘液变性
D. 淀粉样变
E. 脂肪沉积(脂肪变性）

正确答案：E。脂肪沉积(脂肪变性）

解析：脂肪沉淀（E对）是指甘油三酯蓄积于非脂肪细胞的细胞质中，常见于脂肪肝、慢性酒精中毒、缺氧及虎斑心。细胞水肿（A错）是由于细胞容积和胞质离子浓度调节机制功能下降，胞内水钠聚集增多时，细胞肿大明显，呈气球样变，如病毒性肝炎。玻璃样变（B错）是指细胞内或间质中出现半透明状蛋白质蓄积，常见于肾小管上皮细胞，浆细胞胞质粗面内质网及酒精性肝病。粘液样变（C错）是指细胞间质内粘多糖和蛋白质的蓄积，常见于间叶组织肿瘤、动脉粥样硬化斑块、风湿病灶等。淀粉样变（D错）是细胞间质内淀粉样蛋白质和黏多糖复合物蓄积，常发生于皮肤、结膜、舌、喉和肺等处。